恶性程度最高，预后程度最差的乳腺癌是
A. 髄样癌（伴大量淋巴细胞浸润）
B. 髄样癌（不伴大量淋巴细胞浸润）
C. 乳头湿疹样乳头癌
D. 乳头状癌
E. 炎性乳癌

正确答案：E。炎性乳癌

解析：炎性乳癌（E对）并不多见，是发展迅速，恶性程度最高，预后最差的乳腺癌。乳头湿疹样乳腺癌（C错）少见，恶性程度低，发展慢。乳头状癌（D错）、髓样癌（伴淋巴细胞侵润）（A错）属于浸润性特殊癌，分化较高，预后尚好。髓样癌（不伴大量淋巴细胞侵润）（B错）属于浸润性非特殊癌，分化低，预后较差，但较炎性乳癌预后好。